与大气压力作用无关的因素是
A. 基托与黏膜的接触面积
B. 基托与黏膜的密合度
C. 义齿边缘封闭效果
D. 基托磨光面磨光程度
E. 以上都对

正确答案：D。基托磨光面磨光程度

解析：本题考查与大气压力作用有关的因素。基托磨光面是指义齿与唇、颊和舌肌接触的部分，起不到固位的作用，一般基托磨光面应呈凹面，唇、颊、舌肌作用在基托上时能对义齿形成挟持力，使义齿更加稳定，如果磨光面呈凸形，唇、颊、舌肌运动时，将对义齿造成水平力，破坏义齿固位，所以基托磨光面的磨光程度（D错，为本题的正确答案）与大气压力作用无关。当基托与黏膜的密合度（B对）、义齿边缘封闭效果（C对）良好时，在大气压力作用下，两者间可形成功能性负压腔，使义齿获得固位。基托与黏膜的接触面积（A对）与密合程度有关系，故也与大气压力作用有关。